烧伤患者发生的溃疡是
A. Cushing溃疡
B. 胃溃疡
C. Curling溃疡
D. 食管腐蚀性溃疡
E. 十二指肠溃疡

正确答案：C。Curling溃疡

解析：烧伤患者发生的溃疡为Curling溃疡（C对），Cushing溃疡（A错）指继发于严重脑外伤或颅内手术后的溃疡，两者均属于应激性溃疡。胃溃疡（B错）、十二指肠溃疡（E错）与胃酸和蛋白酶的消化有关，属于消化性溃疡。食管腐蚀性溃疡（D错）多与胃食管反流病相关，应有相应病史。